孕40周新生儿，出生时由口鼻排出部分肺内液体，其余经血管及淋巴管吸收的肺液约占
A. 1/4
B. 1/3
C. 1/5
D. 2/3
E. 3/4

正确答案：D。2/3

解析：正常足月儿（P88）是指胎龄≥37周并＜42周，出生体重≥2500g并≤4000g，无畸形或疾病的活产婴儿。题干中孕40周新生儿为正常足月儿，因其出生时经产道挤压约1/3～1/2肺液由口鼻排出，故其余经血管及淋巴管吸收的肺液约占1/2～2/3（D对），考虑题干选项，选择D更为合理。